下列有关根管治疗评价的叙述中，不正确的是
A. 复查包括临床表现和X线片检查
B. X线片示骨缺损开始修复和牙周膜形成，可视为成功
C. X线片示骨缺损范围扩大，则视为失败
D. X线片的骨缺损较治疗前无明显变化，视为成功
E. 患牙出现咬合痛、牙松动，视为失败

正确答案：D。X线片的骨缺损较治疗前无明显变化，视为成功

解析：疗效评价标准和方法：术后6个月、12个月和24个月进行复查。复查包括临床表现和X线片检查两个方面。如果患牙无临床症状和体征，X线片示骨缺损开始修复和牙周膜形成，可视为成功；如果患牙出现咬合痛、牙松动、瘘管或X线片示骨缺损范围扩大，则视为失败；如果患牙未出现临床症状，X线片的骨缺损较治疗前无明显变化，则可以再连续观察一段时间。掌握“疗效评定与牙体修复原则”知识点。